人员培训的原则有
A. 目的明确原则、理论联系实际原则、专业胜任原则
B. 目的明确原则、参与原则、理论联系实际原则
C. 目的明确原则、理论联系实际原则、及时评估原则
D. 参与原则、从实际出发原则、及时评估原则
E. 目的明确原则、弹性原则、理论联系实际原则

正确答案：C。目的明确原则、理论联系实际原则、及时评估原则